利用升华原理除去水分的干燥方法是
A. 常压箱式干燥
B. 流化床干燥
C. 冷冻干燥
D. 红外干燥
E. 微波干燥

正确答案：C。冷冻干燥

解析：本题考查冷冻干燥的原理。冷冻干燥（C对）又称升华干燥。将含水物料冷冻到冰点以下，使水转变为冰，然后在较高真空下将冰转变为蒸气而除去的干燥方法。